有形实邪闭阻气机所致的疼痛，其疼痛性质是
A. 胀痛
B. 灼痛
C. 冷痛
D. 绞痛
E. 隐痛

正确答案：D。绞痛

解析：胀痛为气滞作痛的特点，若头目胀痛，多因肝火上炎或肝阳上亢，非有形实邪（A错）。灼痛多因火邪窜络或阴虚火旺所致，非有形实邪（B错）。冷痛多因寒邪阻滞经络或阳气亏虚，脏腑经脉失于温煦（C错）。绞痛多因有形实邪闭阻气机或寒邪凝滞气机所致。有形之邪闭阻气机，如结石阻滞胆管引起的上腹部绞痛（D对）。隐痛多因阳气精血亏虚，脏腑经脉失养所致，属虚证疼痛（E错）。